某厂喷漆作业工人苯中毒发病严重，下列预防苯中毒的措施中，哪项是根本性措施
A. 改革生产工艺，以无毒或低毒物质代替苯
B. 通风排毒
C. 个人防护
D. 车间空气定期监测
E. 就业前及定期体检

正确答案：A。改革生产工艺，以无毒或低毒物质代替苯